金黄色葡萄球菌感染局限化的物质是
A. 葡萄球菌A蛋白
B. 肠毒素
C. 杀白细胞素
D. 凝固酶
E. 表皮溶解素

正确答案：D。凝固酶

解析：凝固酶（D对）可使细菌周围血液或血浆中的纤维蛋白等沉积于细菌表面，阻碍吞噬细胞的吞噬或胞内消化作用，还能保护病菌不受血清中杀菌物质的破坏，因此血液中的葡萄球菌得以繁殖，引起周围纤维蛋白沉积和凝固，使感染易于局限化和形成血栓。葡萄球菌A蛋白（A错）与IgG结合后所形成的复合物具有抗吞噬、促细胞分裂、引起超敏反应等多种生物活性，其完全抗原的特性与协同凝集试验有关（P91）。肠毒素（B错）是一种热稳定的可溶性蛋白，可抵抗胃肠液中蛋白酶的水解作用，引起食物中毒（P94）。杀白细胞素（C错）是葡萄球菌的毒力因子，使细胞膜发生构型变化，膜通透性增高，细胞浆内的颗粒排出，导致细胞死亡（P94）。表皮溶解素（表皮剥脱毒素）（E错）为金黄色葡萄球菌质粒编码产生的一种蛋白质，可引起烫伤样皮肤综合征（P94）。